牛蒡子不具有的功效是
A. 疏散风热
B. 凉血润燥
C. 宣肺利咽
D. 解毒透疹
E. 消肿疗疮

正确答案：B。凉血润燥

解析：本题考查的是牛蒡子的功效。牛蒡子不具有的功效是凉血润燥（B错，为本题正确答案）。牛蒡子：【功效】疏散风热（A对），宣肺利咽（C对），解毒透疹（D对），消肿疗疮（E对）。凉血润燥为桑叶的功效。桑叶：【功效】疏散风热，清肺润燥，平肝明目，凉血止血。